容纳腭扁桃体的结构为
A. 扁桃体窝
B. 扁桃体小窝
C. 扁桃体上窝
D. 梨状隐窝
E. 咽隐窝

正确答案：A。扁桃体窝

解析：扁桃体窝(A对)内容纳腭扁桃体，扁桃体小窝(B错)位于腭扁桃体上，扁桃体上窝(C错)为扁桃体窝上部无腭扁桃体的部分，梨状隐窝(D错)在喉咽内，咽隐窝(E错)在鼻咽内。